副交感神经的作用是
A. 瞳孔扩大
B. 糖原分解增加
C. 逼尿肌收缩
D. 骨骼肌血管舒张
E. 消化道括约肌收缩

正确答案：C。逼尿肌收缩

解析：副交感神经兴奋时释放乙酰胆碱（ACh）与膀胱逼尿肌M受体结合使逼尿肌收缩（C对），与虹膜环形肌M受体结合虹膜环形肌收缩，瞳孔缩小（A错），与消化道括约肌M受体结合，使其舒张（E错）。支配糖原分解增加（Ｂ错）、骨骼肌血管舒张（D错）的神经纤维均为交感神经。